分子中含有咔唑环结构，通过拮抗5-羟色胺受体产生止吐作用的药物是
A. 甲氧氯普胺
B. 盐酸昂丹司琼
C. 多潘立酮
D. 格拉司琼
E. 盐酸阿扎司琼

正确答案：B。盐酸昂丹司琼

解析：本题考查昂丹司琼。盐酸昂丹司琼（B对）是由由咔唑酮和2-甲基咪唑组成的强效、高选择性的5-HT₃受体阻断药，用于癌症患者或者手术后的恶心和呕吐症状。甲氧氯普胺（A错）是含有苯甲酰胺结构的促胃动力和止吐药。多潘立酮（C错）是含有苯并咪唑结构的促胃动力药。格拉司琼（D错）分子是由吲唑环和含氮双环组成的放疗与化疗止吐药；阿扎司琼（E错）是由1，4-苯并噁嗪和氮杂双环组成的选择性5-HT₃受体阻断药。